下列哪项不是预防职业性汞中毒的措施
A. 以气动仪表代替汞仪表
B. 改善作业环境条件，使空气中汞的浓度不超过0.01mg/m³
C. 车间温度控制在18℃以下
D. 戴防毒口罩
E. 改善作业环境条件，使空气中汞的浓度不超过0.05mg/m³

正确答案：E。改善作业环境条件，使空气中汞的浓度不超过0.05mg/m³